人类的健康管理活动从个体健康管理逐步拓展为设计其工作、生活场所、社区、城市乃至国家甚至更大范围的健康管理行动的原因是
A. 现代健康观内涵和外延的不断拓展
B. 多层次健康社会决定因素理论的提出
C. 健康管理的调整
D. A＋B
E. A＋C

正确答案：D。A＋B

解析：本题考查人类的健康管理活动拓展的原因。人类的健康管理活动从个体健康管理逐步拓展为涉及其工作、生活场所、社区、城市乃至国家甚至更大范围的健康管理行动的原因在于现代健康观内涵和外延的不断拓展以及多层次健康社会决定因素理论的提出（D对ABCE错）。